小学校普通教室小学生人均使用面积不小于
A. 0.5m²
B. 1m²
C. 1.1m²
D. 2.3m²
E. 3.3m²

正确答案：C。1.1m²